以下哪项不是良性肿瘤的特征
A. 一般生长较慢
B. 细胞分化好，细胞形态和结构与正常相似
C. 多呈浸润性生长
D. 一般对机体无影响
E. 一般不发生转移

正确答案：C。多呈浸润性生长

解析：本题考查良性肿瘤的特征。多呈浸润性生长（C错，为本题的正确答案）不是良性肿瘤的特征。良性肿瘤多呈膨胀性生长，浸润性生长是恶性肿瘤的生长特点。良性肿瘤一般生长较慢（A对），能够存在几十年。良性肿瘤细胞分化好，细胞形态和结构与正常相似（B对），故一般对机体无影响（D对）；如果生长在要害部位或者发生并发症也可危机生命。良性肿瘤包膜完整，与周围正常组织分界清楚，一般不发生转移（E对）。